中消的中医治法是
A. 清胃泻火，养阴增液
B. 滋阴固肾
C. 清热润肺，生津止渴
D. 益气健脾，生津止渴
E. 滋阴温阳，补肾固摄

正确答案：A。清胃泻火，养阴增液

解析：中消（胃热炽盛证）主要症状为多食易饥，口渴多尿，形体消瘦，大便干燥，舌红苔黄，脉滑实有力。治法：清胃泻火，养阴增液（A对）。方药应用玉女煎加减。如大便秘结不行，亦用增液承气汤润燥通腑。滋阴固肾法适用于下消（肾阴亏虚证），代表方药是六味地黄丸（B错）。清热润肺，生津止渴适用于上消（肺热伤津证），方是消渴方（C错）。益气健脾，生津止渴适用于下消（气阴两虚证），代表方是七味白术散（D错）。滋阴温阳，补肾固摄适用于阴阳两虚证，代表方是金匮肾气丸（E错）。